关于感染控制中对于患者的评估，需要注意的事项错误的是
A. 患者的信息需要公布，隐私不必保密
B. 患者的信息只能提供给需要信息的治疗人员
C. 没有患者的同意不能将信息披露给第三方
D. 口腔医师不能歧视患有传染性疾病的患者
E. 医护人员有责任采用感染控制措施防止感染传播

正确答案：A。患者的信息需要公布，隐私不必保密

解析：患者健康检查与评估的注意事项：①注意保护患者的隐私。对于一些敏感的问题，要注意场合和方式。患者的信息只能提供给需要信息的治疗人员，没有患者的同意不能披露给第三方；②口腔医师不能歧视患有传染性疾病的患者，拒绝给他们提供治疗是不道德的；③医护人员有责任采用感染控制措施防止感染传播，在自己不被感染又不将感染传播给其他患者的前提下进行治疗。掌握“患者、医务人员及环境的防护”知识点。